女性患儿，七岁半，因后牙变黑在家长陪同下前来就诊。查，右下第一恒磨牙牙冠萌出1/3，但是其（牙合）面多处有黑褐色腐质，探针探软，X线片显示其牙冠阴影位于牙本质浅层，诊断为年轻恒牙中龋。需要进行修复治疗，关于年轻恒牙治疗的特点，以下说法正确的是
A. 去腐时多使用高速手机和裂钻进行切磨
B. 备洞时使用高速切削，提高效率
C. 龋病波及龈瓣下，去腐备洞后进行磷酸锌充填
D. 龋边缘与龈缘边缘平齐，去腐范围为龈缘以上
E. 不应采用预防性扩展，应该采用预防性树脂充填术

正确答案：E。不应采用预防性扩展，应该采用预防性树脂充填术

解析：本题考查年轻恒牙治疗的特点。年轻恒牙治疗的特点中正确的是不应采用预防性扩展，应该采用预防性树脂充填术（E对）。年轻恒牙自洁作用差， 进行龋齿充填时，还应注意与龋患相邻窝沟点隙的防龋处理。在年轻恒牙窝洞制备时不应采用预防性扩展，提倡采用微创的预防性树脂充填术进行治疗。即在窝沟点隙龋仅局限于牙釉质或牙本质表层，去净腐质后，用复合树脂充填窝洞，然后其余相邻的深窝沟用封闭剂封闭，这种修复技术称为预防性树脂充填术。年轻恒牙治疗的特点还有：1.牙体硬组织硬度比成熟恒牙差，备洞时应减速切削（B错），减少牙釉质裂纹。2.髓腔大，髓角尖高，龋齿多为急性，备洞时应避免意外露髓去腐多采用慢速球钻（A错）和挖匙。3.在去腐备洞过程中及充填修复时都要注意保护牙髓，注意无痛操作。波及牙本质中层以下深度时应间接盖髓，同时选择合适的垫底材料，由于磷酸锌对牙髓有刺激，不宜采用（C错）。4.当年轻恒牙萌出不全，远中尚有龈瓣覆盖部分牙冠时发生龋齿处理方法：①如果龋患波及龈瓣下需推开或去除龈瓣，去腐备洞，进行充填。②如果龋患边缘与龈瓣边缘平齐，可以去腐备洞后进行玻璃离子水门汀暂时充填，待完全萌出后，进一步永久充填修复（D错）。